肺胀发病的主要病理因素是
A. 气滞、血瘀、水饮
B. 气滞、水饮、痰浊
C. 痰浊、水饮、血瘀
D. 痰浊、寒邪、血瘀
E. 风邪、痰浊、水饮

正确答案：C。痰浊、水饮、血瘀

解析：本病病理因素痰浊、水饮、瘀血互为影响（C对），兼见同病。痰的产生，初由肺气郁滞，脾失健运，津液不归正化而成，渐因肺虚不能布津，脾虚不能转输，肾虚不能蒸化，痰浊潴留益甚，喘咳持续难已。久延阳虚阴盛，气不化津，痰从阴化为水饮。水饮迫肺、凌心、困脾，可见咳逆上气、心悸气短、纳减呕恶。久则影响气血运行，瘀结胁下。痰浊、水饮、瘀血三者又可相互影响和转化。